我国成人膳食中蛋白质的推荐摄入量为
A. 1.0克/公斤体重
B. 1.16克/公斤体重
C. 1.5克/公斤体重
D. 1.2克/斤体重
E. 2.0克/公斤体重

正确答案：B。1.16克/公斤体重

解析：我国规定轻体力活动成年男子蛋白质推荐摄入量为75g/d，女子65g/d；正常成人蛋白质的推荐摄入量（RNI）为1.16g/kg；按能量计算，成人蛋白质摄入占膳食总能量的10%～12%，儿童青少年为12%～14%。掌握“合理营养指导”知识点。